治疗鼠疫宜选
A. 磺胺嘧啶（SD）+TMP
B. 磺胺甲噁唑（SMZ）+TMP
C. 酞磺胺噻唑（PST）
D. 磺胺醋酰钠（SA）
E. 磺胺嘧啶（SD）+链霉素

正确答案：E。磺胺嘧啶（SD）+链霉素

解析：本题考查药物的联合应用。治疗鼠疫宜选磺胺嘧啶（SD）+链霉素（E对）。磺胺嘧啶（SD）（A错）+甲氧苄啶（TMP）用于治疗流行性脑脊髓膜炎。磺胺甲噁唑（B错）（SMZ）+TMP为复方新诺明，用于治疗呼吸道感染、尿路感染等。酞磺胺噻唑（PST）（C错）临床用于肠炎、菌痢及肠道术前准备。磺胺醋酰钠（SA）（D错）临床主要用于沙眼及眼部其它感染的治疗。